患者腹痛下痢，白多赤少，里急后重，脘腹胀满，头身困重，舌淡苔白腻，脉濡缓.其证型是
A. 阴虚痢
B. 寒湿痢
C. 休息痢
D. 湿热痢
E. 虚寒痢

正确答案：B。寒湿痢

解析：患者腹痛下痢，白多赤少，里急后重可诊断为痢疾，为寒症，又脘腹胀满，头身困重，说明有湿症，而舌苔脉象又符合寒湿痢证型（B对）。湿热痢临床表现：腹部疼痛，里急后重，痢下赤白脓血，黏稠如胶冻，腥臭，肛门灼热，小便短赤：舌苔黄腻，脉滑数（D错）。阴虚痢临床表现：痢下赤白，日久不愈，脓血黏稠，或下鲜血，脐下灼痛，虚坐努责，食少，心烦口干，至夜转剧：舌红绛少津，苔少或花剥，脉细数（A错）。虚寒痢临床表现：腹部隐痛，缠绵不已，喜按喜温，痢下赤白清稀，无腥臭，或为白冻，甚则滑脱不禁，肛门坠胀，便后更甚，形寒畏冷，四肢不温，食少神疲，腰膝酸软：舌淡苔薄白，脉沉细弱（E错）。休息痢临床表现：下痢时发时止，迁延不愈，常因饮食不当、受凉、劳累而发，发时大便次数增多，夹有赤白黏冻，腹胀食少，倦怠嗜卧：舌质淡苔腻，脉濡软或虚数（C错）。